能防御外邪入侵的是
A. 卫气
B. 元气
C. 清气
D. 水气
E. 谷气

正确答案：A。卫气

解析：本题考查的是气的生理功能。能防御外邪入侵的是卫气（A对）。卫气：与营气相对而言，卫气行于脉外而属阳，又称“卫阳”。卫气的生理功能有三个方面：一是护卫肌表，防御外邪入侵；二是温养脏腑、肌肉、皮毛等；三是调节控制汗孔的开合和汗液的排泄，以维持体温的相对恒定。所以，人体卫外功能的强弱，以及能否维持体温的相对恒定，同卫气的功能活动是否正常有着密切关系。元气（B错）：又称“原气”，是人体最基本、最重要的气，是人体生命活动的原动力。元气的生理功能：推动和促进人体的生长发育，温煦和激发各脏腑、经络等组织器官的生理活动。元气是人体生命活动的原动力，是维持人体生命活动的最基本的物质。机体元气充沛，则各脏腑、经络等组织器官的活力旺盛，体质强健而少病。若因先天禀赋不足，或因后天水谷失养，或因久病损耗，以致元气的生成不足或耗伤太过时，就会形成元气虚衰而产生种种病变。清气（C错）来自自然界，是气的来源之一。水气（D错）指体内不正常的水液。谷气（E错），即水谷精气，由饮食水谷经脾胃运化而成。